硬脑膜窦叙述错误的是
A. 由两层硬脑膜分开形成
B. 无平滑肌，不能收缩
C. 海绵窦与面静脉相交通
D. 大脑大静脉注入直窦
E. 横窦直接注入颈内静脉

正确答案：E。横窦直接注入颈内静脉

解析：硬脑膜由两层硬脑膜分开形成（A对），内面衬以内皮细胞，构成硬脑膜窦， 窦内含静脉血，窦壁无平滑肌，不能收缩（B对），故损伤出血时难以止血，容易形成颅内血肿。海绵窦向前借眼静脉与面静脉交通（C对），向下经卵圆孔的小静脉与翼静脉丛相通，故面部感染可经上述交通蔓延至海绵窦。由大脑大静脉和下矢状窦汇合成直窦（D对）。横窦经过乙状窦，才能注入到颈内静脉（E错，为本题正确选项）。